富含无机盐、水溶性维生素和膳食纤维的食物是
A. 以下都不是
B. 蔬菜
C. 谷类
D. 肉类
E. 蛋类

正确答案：B。蔬菜

解析：蔬菜（B对）是富含无机盐、水溶性维生素和膳食纤维的食物。奶制品和谷类（AC错）富含钙、优质蛋白质和B族维生素。肉类和蛋类（DE错）富含优质蛋白质和AB族维生素，有些也含有较高的脂肪和胆固醇。